某患者曾有颏部受力外伤史，后出现进行性开口困难，逐渐发展到完全不能张口，下颌发育不足，左侧髁状突无动度，可能出现的其他表现应该是
A. 左侧下颌体、下颌支长，外观丰满
B. 左侧下颌体、下颌支短小，外观丰满
C. 颏部偏向右侧，下颌支短小、狭长
D. 颏部偏向左侧，左侧面部扁平、狭长
E. 颏部偏向右侧，右侧面部外观丰满

正确答案：B。左侧下颌体、下颌支短小，外观丰满

解析：关节内强直临床表现：①进行性开口困难。②面下部发育畸形，表现为面部两侧不对称，颏部偏向患侧；患侧下颌体、下颌支短小，患侧面部丰满；双侧强直者形成特殊的小颌畸形面容。发病年龄愈小，颜面部发育畸形愈严重，严重者可致阻塞性睡眠呼吸暂停综合征。③咬合关系紊乱，如果关节强直发病于成年人或青春发育期以后，则面部和咬合关系无明显畸形，仅有开口受限。④髁突活动减弱或消失。⑤X线检查有助于诊断并鉴别纤维性强直和骨性强直。CT及三维重建检查可判断粘连范围、部位及程度。掌握“颞下颌关节强直”知识点。